患者，女，63岁，高血压病史10年，使用硝苯地平控释片和厄贝沙坦片降压治疗。近期午睡后血压升高到160/85mmHg，心率60次/分。宜加用的药物是
A. 氢氯噻嗪
B. 福辛普利
C. 氨氯地平
D. 伊伐布雷定
E. 比索洛尔

正确答案：A。氢氯噻嗪

解析：本题考查降压药物的联合应用。二氢吡啶类CCB+ACEI（或ARB）+噻嗪类利尿剂（A对）组成的联合方案最为常用。
患者使用的药物中有ARB，不宜与ACEI类进行联用（B错）。患者所用药物已经含有CCB，不宜再加用同类药物（C错）。患者心率处于正常心率的最低值，不宜使用降低心率的药物（DE错）。